下列哪种食物中的蛋白质属于优质蛋白质
A. 大米
B. 玉米
C. 大豆及豆制品
D. 面粉
E. 麦片

正确答案：C。大豆及豆制品